治疗青霉素高度耐药的肺炎链球菌感染首选
A. 氧氟沙星、环丙沙星与万古霉素合用
B. 氧氟沙星、莫西沙星与万古霉素合用
C. 左氧氟沙星、莫西沙星与万古霉素合用
D. 左氧氟沙星、环丙沙星与万古霉素合用
E. 左氧氟沙星、莫西沙星与诺氟沙星合用

正确答案：C。左氧氟沙星、莫西沙星与万古霉素合用

解析：呼吸系统感染：左氧氟沙星、莫西沙星与万古霉素合用，首选用于治疗青霉素高度耐药的肺炎链球菌感染。氟喹诺酮类可用于支原体肺炎、衣原体肺炎、嗜肺军团菌引起的军团病。掌握“喹诺酮类”知识点。